颊（颊长）神经阻滞麻醉时不会麻醉
A. 磨牙颊侧牙龈
B. 磨牙黏骨膜
C. 侧切牙唇黏膜
D. 颊肌
E. 下颌第二前磨牙颊部黏膜

正确答案：C。侧切牙唇黏膜

解析：颊（颊长）神经阻滞麻醉区域及效果：同侧下颌第二前磨牙及磨牙颊侧牙龈、黏骨膜、颊部黏膜、颊肌和皮肤。局部可有肿胀、麻木感。掌握“颌面部常用局麻法及牙拔除的麻醉选择”知识点。